女，43岁，G3P1，初产，宫底在脐与剑突之间，胎心142次/分，羊水的主要来源是
A. 胎儿尿液和肺
B. 胎儿尿液和脐带
C. 胎儿尿液和皮肤
D. 胎儿尿液和胎膜
E. 母体血清和胎儿尿液

正确答案：A。胎儿尿液和肺

解析：宫底在脐与剑突之间，正常情况下可以判断孕周大概在32周，孕晚期。妊娠早期羊水主要来自母体血清经胎膜进入羊膜腔的透析液（D错）；妊娠中期以后，羊水的主要来源是胎儿尿液妊娠晚期胎儿肺参与羊水的生成（A对BCE错）。